根据处方药与非处方药分类管理的相关规定，关于非处方药遴选原则解释的说法，错误的是
A. 应用安全，系指经过长期临床使用证实，药品无潜在毒性，不易引起蓄积中毒，基本无不良反应，不引起依赖性
B. 疗效确切，系指药物针对性强功能主治明确，不需要调整剂量，连续使用不易引起耐药性
C. 质量稳定，系指药品质量可控、性质稳定
D. 使用方便，系指不用经过特殊检查和试验即可使用，以口服和外用的常用剂型为主

正确答案：B。疗效确切，系指药物针对性强功能主治明确，不需要调整剂量，连续使用不易引起耐药性

解析：本题考查的是非处方药的遴选原则。疗效确切，系指药物作用针对性强，功能主治明确；不需要经常调整剂量；连续使用不引起耐药性（B错，为本题正确答案）。非处方药的遴选：为了配合药品分类管理制度的推行，我国于1999开始对非处方药进行遴选并公布非处方药目录。非处方药根据以下原则遴选：（1）应用安全：长期临床使用证实安全性大；无潜在毒性，不易引起蓄积中毒，中药中的重金属限量不超过国内或国外公认标准；基本无不良反应；不引起依赖性（A对），无“三致”作用；医疗用毒性药品、麻醉药品以及精神药品原则上不能作为非处方药，但个别麻醉药品与少数精神药品可作为“限复方制剂活性成分”使用；组方合理，无不良相互作用，比如中成药组方中无“十八反”“十九畏”等。（2）疗效确切：药物作用针对性强，功能主治明确；不需要经常调整剂量；连续使用不引起耐药性。（3）质量稳定：质量可控、性质稳定（C对）。（4）使用方便：不用经过特殊检查和试验即可使用；以口服和外用的常用剂型为主（D对）。